因分泌不足而引起呆小症的激素是
A. 胰岛素
B. 生长激素
C. 生长抑素
D. 甲状旁腺素
E. 甲状腺素

正确答案：E。甲状腺素